二巯基丙磺酸钠常用于治疗
A. 苯中毒
B. 汞中毒
C. 镉中毒
D. 铅中毒

正确答案：B。汞中毒

解析：本题考查汞中毒的治疗。急性汞中毒治疗原则：迅速脱离现场，脱去污染衣服，静卧，保暖。慢性中毒治疗原则：应调离汞作业及其他有害作业。无论是急性汞中毒还是慢性汞中毒（B对ACD错）都应当采取二巯基丙磺酸钠或二巯基丁二酸钠治疗。